牙周手术时，颊舌侧龈瓣高度不一致时，应采用的缝合方法
A. 牙间间断缝合
B. 间断缝合
C. 悬吊缝合
D. 锚式缝合
E. 褥式缝合

正确答案：C。悬吊缝合

解析：悬吊缝合：是利用术区的牙齿来悬吊固定龈瓣，尤其适用于颊、舌两侧龈瓣高度不一致时，使每侧龈瓣分别在所复位的水平紧密地贴合于牙与骨面，不易发生松脱或过大张力。掌握“慢性牙周炎的治疗原则、程序及方法”知识点。